鸡血藤的功效是
A. 活血行气，祛风止痛
B. 活血行气，凉血清心
C. 活血定痛，泻下通便
D. 逐瘀通经，引血下行
E. 行血补血，舒筋活络

正确答案：E。行血补血，舒筋活络

解析：本题考查的是鸡血藤的功效。鸡血藤的功效是行血补血，舒筋活络（E对）。鸡血藤：【功效】活血补血，调经止痛，舒筋活络。川芎：【功效】活血行气，祛风止痛（A错）。郁金：【功效】活血止痛，行气解郁，凉血清心（B错），利胆退黄。虎杖：【功效】利湿退黄，清热解毒，活血祛瘀，化痰止咳，泻下通便（C错）。川牛膝：【功效】逐瘀通经，通利关节，利尿通淋，引血下行（D错）。